关于药品标签、说明书管理的说法，错误的是
A. 同一药品上市许可持有人生产的同一药品，分别按处方药与非处方药管理的，二者包装颜色必须明显区别
B. 由于包装尺寸或者技术设备等原因，标签中的有效期无法标注“有效期至某年某月”的，可以标注有效期实际期限
C. 对贮藏有特殊要求的药品，应当在标签的醒目位置注明
D. 药品内标签至少应当标注药品通用名称、产品批号和有效期

正确答案：D。药品内标签至少应当标注药品通用名称、产品批号和有效期

解析：本题考查药品标签的标识内容。关于药品标签、说明书管理的说法，错误的是药品内标签至少应当标注药品通用名称、产品批号和有效期（D错，为本题正确答案）。内标签包装尺寸过小无法全部标明上述内容的，至少应当标注药品通用名称、规格、产品批号、有效期等内容。同一药品生产企业生产的同一药品，分别按处方药与非处方药管理的，两者的包装颜色应当明显区别（A对）。如果由于包装尺寸或者技术设备等原因有效期确难以标注为“有效期至某年某月”的，可以标注有效期实际期限，如“有效期24个月”（B对）。对贮藏有特殊要求的药品，应当在标签的醒目位置注明（C对）。